不属于正治法的是
A. 寒者热之
B. 热者寒之
C. 虚则补之
D. 以通治通
E. 实则泻之

正确答案：D。以通治通

解析：本题考查的是正治。以通治通属于反治法（D错，为本题正确答案）。正治，又称逆治，是指采用方药的性质与疾病的证候性质相反的治疗法则。正治，适用于临床表现与疾病证候本质相一致的病证。常用的治法有寒者热之（A对）、热者寒之（B对）、虚则补之（C对）、实则泻（E对）之等。1.寒者热之：寒者热之又称“以热治寒”；2.热者寒之：热者寒之又称“以寒治热”；3.虚则补之；4.实则泻之。反治，又称从治，是指顺从疾病证侯的外在假象而治的治疗法则。反治，适用于临床表现与疾病证候本质不完全一致的病症。反治，主要包括热因热用、寒因寒用、塞因塞用、通因通用四种治法。1.热因热用：热因热用又称“以热治热”；2.寒因寒用：寒因寒用又称“以寒治寒”；3.塞因塞用：塞因塞用又称“以补开塞”；4.通因通用：通因通用又称“以通治通”。